排除药物性肝损害的依据是
A. 肝肿大
B. 肝脏压痛
C. 肝区疼痛
D. 转氨酶升高
E. 病毒检测阳性

正确答案：E。病毒检测阳性

解析：本题考查的是中药引起肝损害的临床表现。排除药物性肝损害的依据是病毒检测阳性（E错，为本题正确答案）。中药引起肝损害的临床表现：主要为全身表现和急性肝损害。全身表现为纳差、乏力、恶心、厌油腻、尿黄等症状及皮肤、巩膜黄染等体征，也可有肝区疼痛（C对）、肝脏压痛（B对）、肝肿大（A对）；肝功能的改变，可有血清总胆红素升高、转氨酶异常升高（D对），甲、乙、丙、丁、戊肝炎病毒检验全阴性，可有急性肝炎、慢性肝炎、脂肪变性而致的中毒性肝炎、急性亚急性黄色肝萎缩的表现。及时停药并对症治疗，多数患者临床症状和肝功能损害可于短期内恢复，预后良好。